中药汤剂煎煮时，需包煎的饮片是
A. 人参
B. 阿胶
C. 钩藤
D. 海金沙
E. 鹿角霜

正确答案：D。海金沙

解析：本题考查的是中药特殊煎服法。中药汤剂煎煮时，需包煎的饮片是海金沙（D对）。中药特殊煎服法：1.先煎：先煎的目的是为了延长药物的煎煮时间，使药物中难溶性成分充分煎出。一般来说，需先煎的饮片，经武火煮沸后文火煎煮10～15分钟后再与用水浸泡过的其他药物合并煎煮。需要先煎的药物有以下几类。（1）矿物、动物骨甲类饮片。因其质地坚硬，有效成分不易煎出，故应打碎先煎约15分钟，方可与其他药物同煎。如蛤壳、紫石英、石决明、珍珠母、瓦楞子、鳖甲、龟甲、鹿角霜（E错）、磁石、牡蛎、生石膏、赭石、自然铜等。水牛角宜先煎3小时以上。（2）某些有毒饮片。一般应先煎1～2小时达到降低毒性或消除毒性的目的。如含有毒成分乌头碱的川乌、草乌或制附子，经1～2小时的煎煮后，可使乌头碱分解为乌头次碱，进而分解为乌头原碱，使毒性大为降低。2.后下：后下的目的是为了缩短药物的煎煮时间，减少药物因煎煮时间过久所造成的成分散失。一般来说，在其他群药文火煎煮15～20分钟后，放入需后下的饮片再煎煮5～10分钟即可。需要后下的药物有以下几类。（1）气味芳香类饮片，因其含挥发性成分故不宜煎煮时间过久，以免其有效成分散失，一般在其他群药煎好前5～10分钟入煎即可。如降香、沉香、薄荷、砂仁、白豆蔻、鱼腥草等。（2）久煎后有效成分易被破坏的饮片，一般在其他群药煎好前10～15分钟入煎即可。如钩藤（C错）、苦杏仁、徐长卿、生大黄、番泻叶等。3.包煎：包煎即是把需包煎的饮片装在用棉纱制成的布袋中，扎紧袋口后与群药共同煎煮。需要包煎的药物主要有以下几类。（1）含黏液质较多的饮片，包煎后可避免在煎煮过程中黏煳锅底。如车前子、葶苈子等。（2）富含绒毛的饮片，包煎后可避免脱落的绒毛混入煎液后刺激咽喉引起咳嗽。如旋覆花、枇杷叶等。（3）花粉等微小饮片，因总表面积大，疏水性强，故也宜包煎，以免因其漂浮而影响有效成分煎出。如蒲黄、海金沙、蛤粉、六一散等。4.烊化（溶化）：胶类中药不宜与群药同煎，以免因煎液黏稠而影响其他药物成分的煎出或结底煳化。可将此类药置于已煎好的药液中加热溶化后一起服用。也可将此类药置于容器内，加适量水，加热溶化或隔水炖化后，再兑入群药煎液中混匀分服。如阿胶（B错）、鳖甲胶、鹿角胶、龟鹿二仙胶等。5.另煎：一些贵重中药饮片，为使其成分充分煎出，减少其成分被其他药渣吸附引起的损失，需先用另器单独煎煮取汁后，再将渣并入其他群药合煎，然后将前后煎煮的不同药液混匀后分服。如人参（A错）、西洋参等质地较疏松者，通常视片型、体积等另煎0.5～1小时。而羚羊角等质地坚硬者，则应单独煎煮2小时以上。西红花亦可沸水泡服。6.兑服：对于液体中药，放置其他药中煎煮，往往会影响其成分，故应待其他药物煎煮去渣取汁后，再行兑入服用。如黄酒、竹沥水、鲜藕汁、姜汁、梨汁、蜂蜜等。7.冲服：贵细中药用量少，宜先研成粉末再用群药的煎液冲服，避免因与他药同煎而导致其成分被药渣吸附而影响药效。如雷丸、蕲蛇、羚羊角、三七、川贝、琥珀、鹿茸、紫河车、沉香、金钱白花蛇等。8.煎汤代水：对于质地松泡、用量较大，或泥土类不易滤净药渣的药物，可先煎15～25分钟，去渣取汁，再与其他药物同煎。如葫芦壳、灶心土等。